运用药物的归经理论还须考虑
A. 药物的用量
B. 药物的用法
C. 药物的四气五味升降浮沉
D. 药物的采集
E. 药物的炮制

正确答案：C。药物的四气五味升降浮沉

解析：在运用归经理论指异药物临床应用时，还必须与四气五味、升降浮沉学说结合起来，才能做到全面准确（C对）。四气五味、升降浮沉、归经同是药性理论的重要组成部分，在应用时必须结合起来，全面分析，才能准确地指导临床用药。